某男，81岁。患消渴病20年，小便频数，甚则饮一溲一，咽干舌燥，面容憔悴，耳轮干枯，腰膝酸软，畏寒肢冷；舌白少津，脉沉细无力。服药1个月上述症状缓解，停药后，近日又见溺痛，不甚赤涩，但淋沥不已，时作时止，遇劳即发，腰膝酸软下力；舌淡，脉细弱。宜选用的中成药是
A. 萆薢分清丸
B. 六味地黄丸
C. 肾炎灵胶囊
D. 分清五淋丸
E. 前列回春胶囊

正确答案：E。前列回春胶囊

解析：本题考查的是淋证的辨证论治。某男，81岁。患消渴病20年，小便频数，甚则饮一溲一，咽干舌燥，面容憔悴，耳轮干枯，腰膝酸软，畏寒肢冷；舌白少津，脉沉细无力。服药1个月上述症状缓解，停药后，近日又见溺痛，不甚赤涩，但淋沥不已，时作时止，遇劳即发，腰膝酸软下力；舌淡，脉细弱。宜选用的中成药是前列回春胶囊（E对）。淋证是指以小便频数短涩，淋沥刺痛，小腹拘急引痛为主症的疾病。西医学的泌尿系感染、尿路结石、前列腺炎、尿道综合征等病，具有淋证表现特征者，可参考此内容辨证论治。（一）热淋：【症状】小便频数短涩，灼热刺痛，尿色黄赤，少腹拘急胀痛，或有寒热，口苦，呕恶，或腰痛拒按，或大便秘结。舌质红，苔黄腻，脉滑数。【中成药应用】常用中成药有八正胶囊、复肾宁片、分清五淋丸（D错）。（二）石淋：【症状】尿中夹有砂石，排尿涩痛，或排尿时突然中断，尿道窘迫疼痛，少腹拘急，往往突发一侧腰腹绞痛难忍，甚则牵及外阴，尿中带血。舌质红，苔薄黄，脉弦或弦数。【中成药应用】常用中成药有复方金钱草颗粒、净石灵胶囊、五淋化石丸。（三）血淋：【症状】小便热涩刺痛，尿色深红，或夹有血块，疼痛满急加剧，或见心烦。舌尖红，舌苔黄，脉滑数。【中成药应用】常用中成药有肾炎灵胶囊（C错）、五淋丸。（四）气淋：【症状】郁怒之后，小便涩滞，淋沥不宣，少腹胀满疼痛。舌苔薄白，脉弦。【中成药应用】常用中成药有为柴胡舒肝丸。（五）膏淋：【症状】小便浑浊，乳白或如米泔水，上有浮油，置之沉淀，或伴有絮状凝块物，或混有血液、血块，尿时热涩疼痛，口干。舌质红，苔黄腻，脉濡数。【中成药应用】常用中成药有为萆薢分清丸（A错）、前列泰片。（六）劳淋：【症状】小便不甚赤涩，溺痛不甚，但淋沥不已，时作时止，遇劳即发，腰膝酸软，神疲乏力，病程缠绵。舌质淡，脉细弱。【中成药应用】常用中成药有为前列回春胶囊、男康片。消渴肾阴亏虚证：【症状】尿频量多，浊如膏脂，腰酸膝软，头晕耳鸣，多梦遗精，乏力，皮肤干燥。舌红少苔，脉细数。【中成药应用】常用中成药有六味地黄丸（水蜜丸）（B错）、麦味地黄丸（水蜜丸）。